以下哪项不是健康管理的基本策略
A. 生活方式管理
B. 需求管理
C. 保健管理
D. 灾难性病伤管理
E. 疾病管理

正确答案：C。保健管理

解析：健康管理的基本策略是通过评估和控制健康风险，达到维护健康的目的。其基本策略有以下六种形式：生活方式管理、需求管理、疾病管理、灾难性病伤管理、残疾管理和综合的群体健康管理。掌握“临床预防服务概述”知识点。